女，35岁，2个月前驾车发生重大交通事故致丈夫身亡，自己轻伤。近1个月频频噩梦，梦境中反复呈现车祸惨象，时常感到心悸不安，不敢看交通事故的新闻，不敢再驾车，情感麻木，郁郁寡欢。该患者的诊断是
A. 抑郁症
B. 焦虑症
C. 创伤后应激障碍
D. 急性应激障碍
E. 适应障碍

正确答案：C。创伤后应激障碍

解析：该患者2个月前驾车发生重大交通事故致丈夫身亡（受到异乎寻常的创伤性事件），近1个月反复噩梦呈现车祸惨象（反复出现创伤性体验），时常感到心悸不安，不敢看交通事故的新闻、再驾车（回避行为），故诊断为创伤性应激障碍（C对）。急性应激障碍（D错）患者在急剧、严重的精神刺激下，患者立即表现有强烈恐惧体验的精神运动性兴奋（激越，喊叫，行为过多），行为具有一定的盲目性，或者为精神运动性抑制，甚至木僵，这些症状往往在24 ～48小时后开始减轻，一般不超过１周，如果症状超过4周（近1个月），应该考虑诊断为创伤后应激障碍。